造成器官损害与致残的不良反应属于
A. 可疑不良反应
B. 一般不良反应
C. 严重不良反应
D. 罕见不良反应
E. 新的不良反应

正确答案：C。严重不良反应